下列属于肾功能受损评价指标的有
A. 尿蛋白（PRO）
B. 尿素氮（BUN）
C. 肌酐清除率（Clcr）
D. 血清肌酐（Scr）
E. 肾素（Renin）

正确答案：B、C、D。尿素氮（BUN）；肌酐清除率（Clcr）；血清肌酐（Scr）